最常出现ANCA（中性粒细胞胞浆抗体）阳性的肾病是
A. 急进性肾小球肾炎
B. 急性肾小球肾炎
C. 狼疮肾炎
D. 急性间质性肾炎
E. 急性肾小管坏死

正确答案：A。急进性肾小球肾炎

解析：最常出现ANCA（中性粒细胞胞浆抗体）阳性的肾病是Ⅲ型急进性肾小球肾炎（A对）。ANCA是诊断血管炎的一种特异性指标，主要有两型：胞质型（cANCA）和核周型（pANCA）。cANCA主要见于韦格纳肉芽肿，此外还有坏死性血管炎、微小多动脉炎、结节性多发性动脉炎。pANCA主要与多发性微动脉炎相关，常见于快速进行性血管炎性肾炎、多动脉炎、自身免疫性肝炎等。急性肾小球肾炎（P466）（B错）常有C3及总补体下降，狼疮肾炎（P482）（C错）常有抗dsDNA抗体阳性。急性间质性肾炎（P488）（D错）及急性肾小管坏死（P511）（E错）均无特异性抗体。